下列哪一项不是牙颌面畸形临床分类
A. 颌骨发育过度所致牙颌面畸形
B. 颌骨发育不足所致牙颌面畸形
C. 牙源性错（牙合）畸形
D. 对称性牙颌面畸形
E. 复合性牙颌面畸形

正确答案：D。对称性牙颌面畸形

解析：本题考查牙颌面畸形。对称性牙颌面畸形（D错，为本题正确答案）不是牙颌面畸形临床分类。以颅、颌、（牙合）三维空间关系异常为基础的牙颌面畸形分类法：①颌骨发育过度所致牙颌面畸形（A对）；②颌骨发育不足所致牙颌面畸形（B对）；③长面畸形（AngleⅡ类（牙合））；④牙源性错（牙合）畸形（C对）（AngleⅠ类（牙合））；⑤复合性牙颌面畸形（E对）；⑥不对称性牙颌面畸形。